具有强心作用的是
A. 斑蝥素
B. 蜂毒
C. 乌贼墨
D. 蟾毒配基类
E. 水蛭素

正确答案：D。蟾毒配基类

解析：本题考查的是蟾毒配基类的药理作用。具有强心作用的是蟾毒配基类（D对）。蟾毒配基类为蟾酥的主要化学成分，属于甾体化合物，具有强心作用。斑蝥素（A错）为斑蝥是主要化学成分。斑蝥素具有抗肿瘤作用，包括抗肺癌作用、抗肝癌作用、抗卵巢癌作用、抗胰腺癌作用、抗宫颈癌作用等。水蛭素（E错）为水蛭的主要化学成分。水蛭素是水蛭的主要有效药用成分。水蛭的药理作用：水蛭具有抗凝血、抗血栓形成、改善血液流变性、脑保护、抗脑缺血、抗炎、保护肾脏、抗组织纤维化等作用。蜂毒（B错）与乌贼墨（C错）的药理作用，2022年考试指南未明确说明。